土壤的卫生防护原则不包括
A. 杀灭土壤中的所有微生物和寄生虫卵
B. 实行粪便、垃圾无害化处理
C. 对含有毒物的污水进行净化，回收处理
D. 合理使用农药化肥
E. 治理工业废渣

正确答案：A。杀灭土壤中的所有微生物和寄生虫卵

解析：本题考查土壤的卫生防护原则。土壤的卫生防护原则包括：1.实行粪便、垃圾无害化处理（B对）；2.对含有毒物的污水进行净化，回收处理（C对）；3.合理使用农药化肥（D对）；4.治理工业废渣（E对）。杀灭土壤中的所有微生物和寄生虫卵（A错，为本题正确答案）不是土壤的卫生防护原则。